评价药物制剂靶向性参数有
A. 包封率
B. 相对摄取率
C. 载药量
D. 峰浓度比
E. 清除率

正确答案：B、D。相对摄取率；峰浓度比

解析：本题考查评价药物制剂靶向性参数。药物制剂的靶向性可由相对摄取率re（B对）、靶向效率te、峰浓度比Ce（D对）等参数来衡量。包封率（A错）、载药量（C错）是脂质体质量评价方法。清除率（E错）是反映药物从血浆中被除去的能力的参数。